晶状体凸度增大时
A. 瞳孔开大肌舒张
B. 瞳孔开大肌收缩
C. 睫状肌收缩
D. 睫状肌舒张
E. 瞳孔括约肌收缩

正确答案：C。睫状肌收缩

解析：视近物时，睫状肌收缩（C对），使睫状突内伸，睫状小带变松弛，晶状体借助于晶状体囊及其本身的弹性而凸度增大；视远物时，睫状肌舒张（D错），使睫状突外伸，睫状小带加强了对晶状体的牵拉，晶状体曲度变小。